龟甲的主要归经是
A. 肺、胃、肾经
B. 肺、脾、肾经
C. 心、脾、肾经
D. 心、肝、肾经
E. 心、肝、脾经

正确答案：D。心、肝、肾经

解析：该题考查的是龟甲的归经，属记忆内容。龟甲甘，寒。归肾、肝、心经。（D对ABCE错）